小儿体格发育最快的时期是
A. 幼儿期
B. 新生儿期
C. 学龄期
D. 学龄前期
E. 婴儿期

正确答案：E。婴儿期

解析：生长发育在整个小儿时期不断进行，但各年龄阶段生长发育并非等速进行。体格的生长基本上是年龄越小增长越快，如体重、身长在生后第一年，尤其是生后最初6个月增长很快，后半年逐渐减慢，但至青春期生长速度又猛然加快（E对）。